2型肥胖型糖尿病患者宜选用的药物是
A. 胰岛素
B. 格列喹酮
C. 二甲双胍
D. 普伐他汀
E. 阿卡波糖

正确答案：C。二甲双胍

解析：本题考查降糖药。2型肥胖型糖尿病患者宜选用的药物是二甲双胍（C对）。胰岛素（A错）主要用于1型糖尿病的治疗。格列喹酮（B错）可作为糖尿病合并肾病者首选。阿卡波糖（E错）为单纯餐后血糖高的糖尿病患者首选。普伐他汀（D错）适用于饮食限制仍不能控制的原发性高胆固醇血症或合并有高甘油三酯血症患者。